对放疗敏感的卵巢肿瘤
A. 浆液性癌
B. 无性细胞瘤
C. 胚胎瘤
D. 卵黄囊瘤
E. 未成熟畸胎瘤

正确答案：B。无性细胞瘤

解析：放射治疗虽能治疗无性细胞瘤（B对），但会破坏患者卵巢功能，已极少应用，仅用于治疗复发的无性细胞瘤。